桔梗具有的功效是
A. 温肺祛痰
B. 降气止呕
C. 开宣肺气
D. 燥湿化痰
E. 利气宽胸

正确答案：C。开宣肺气

解析：桔梗辛散苦泄，能够开宣肺气，祛痰利咽，开音；本品性散上行，能利肺气以排壅肺之脓痰（C对）。白芥子的功效是温肺祛痰（A错），利气散结，通络止痛。旋覆花的功效是降气止呕（B错），降逆，化痰。半夏的功效燥湿化痰（D错），降逆止呕，消痞散结，外用消肿止痛。薤白的功效是利气宽胸（E错），通阳散结。